普萘洛尔的作用靶点是
A. 血管紧张素转化酶
B. β-肾上腺素受体
C. 羟甲戊二酰辅酶A还原酶
D. 钙离子通道
E. 钾离子通道

正确答案：B。β-肾上腺素受体

解析：本题考查普萘洛尔。普萘洛尔的作用靶点是β-肾上腺素受体（B对）。血管紧张素转化酶（ACE）（A错）是血管紧张素转化酶抑制剂的作用靶点。羟甲戊二酰辅酶A还原酶（HMG-CoA还原酶）（C错）是HMG-CoA还原酶抑制剂的作用靶点。钙离子通道（D错）与钾离子通道（E错）为特异性允许钙离子或钾离子通过质膜的通道，不是普萘洛尔的作用靶点。